根据《中华人民共和国药品管理法实施条例》，《医疗机构制剂许可证》的许可事项发生变更的，提出变更登记申请期限为
A. 7日
B. 15日
C. 30日
D. 3个月
E. 6个月

正确答案：C。30日

解析：本题考查医疗机构制剂许可证的管理。根据《中华人民共和国药品管理法实施条例》，《医疗机构制剂许可证》的许可事项发生变更的，提出变更登记申请期限为30日（C对）。《中华人民共和国药品管理法实施条例》第四章医疗机构的药剂管理第二十一条：医疗机构变更《医疗机构制剂许可证》许可事项的，应当在许可事项发生变更30日前，依照本条例第二十条的规定向原审核、批准机关申请《医疗机构制剂许可证》变更登记；未经批准，不得变更许可事项。原审核、批准机关应当在各自收到申请之日起15个工作日（B错）内作出决定。医疗机构新增配制剂型或者改变配制场所的，应当经所在地省、自治区、直辖市人民政府药品监督管理部门验收合格后，依照前款规定办理《医疗机构制剂许可证》变更登记。第二十二条：《医疗机构制剂许可证》有效期为5年。有效期届满，需要继续配制制剂的，医疗机构应当在许可证有效期届满前6个月（E错），按照国务院药品监督管理部门的规定申请换发《医疗机构制剂许可证》。医疗机构终止配制制剂或者关闭的，《医疗机构制剂许可证》由原发证机关缴销。